判断肺血栓栓塞患者需要溶栓治疗的主要依据是
A. 出现呼吸衰竭
B. 出现肺动脉高压
C. 存在体循环功能障碍
D. 出现右心功能异常
E. 合并下肢深静脉血栓

正确答案：C。存在体循环功能障碍

解析：溶栓治疗主要适用于高危（大面积）PTE病例（有明显呼吸困难、胸痛、低氧血症等），因此出现明显高危症状为溶栓治疗的主要依据。肺血栓栓塞患者出现呼吸衰竭（A错）、肺动脉高压（B错）和右心功能不全（D错）均属于中低危，体循环功能障碍（C对）低血压属于高危。合并下肢深静脉血栓并不是溶栓的适应症（E错）。
         低危         中危                        高危
血压 正常           正常                     降低
右心 正常           降低                    降低
         抗凝     溶不溶+抗凝      溶栓+抗凝